心室颤动导致不可逆性脑损害，其发作至少持续
A. 4～6分钟
B. 7～9分钟
C. 30秒
D. 1～3分钟
E. 10分钟

正确答案：A。4～6分钟

解析：当发生心室颤动时，心脏不能有效泵血，血液中红细胞携带的氧气不能经过循环得到补充，但原有血液红细胞所携带的氧气并没有完全释放，此时可继续供应氧气，因而机体组织器官可以耐受短暂的心室颤动。脑组织耐受机体缺氧的时间为4～6分钟（A对BCDE错），如果超出这个时间血液中的氧气仍然得不到补充，脑组织将不能再从血液中获取氧气，即发生不可逆性脑损害。